什么增加，导致城市生活设施负担加重，带来许多新的健康问题
A. 环境污染
B. 生活方式
C. 现代文明病
D. 心理健康
E. 人口流动

正确答案：E。人口流动